一位性病患者刚刚离去，就有人询问医生该患者得了什么病，医生告之是性病。患者的哪项权利受到了侵犯
A. 享受医疗服务
B. 免除健康时的责任
C. 保守个人秘密
D. 及时就医
E. 患者的经济利益

正确答案：C。保守个人秘密